阿胶的主治病症是
A. 阴虚燥咳
B. 表虚自汗
C. 胃痰呕吐
D. 湿热泻痢
E. 风寒湿痹

正确答案：A。阴虚燥咳

解析：阿胶性味甘、平，归肺、肝、肾经，能滋阴润肺，用治肺热阴虚，燥咳痰少，咽喉干燥，痰中带血等证（A对）。